迁延性腹泻一般是指病程在
A. 1～4周
B. 2周～2个月
C. 4周～2个月以内
D. 4周～6个月
E. 2周～4个月

正确答案：B。2周～2个月

解析：本题考查迁延性腹泻。迁延性腹泻一般是指病程超过2周但未超过2个月（B对ACDE错）。